在生产条件下，金属汞主要以下列哪种形式经呼吸道进入人体
A. 粉尘
B. 烟
C. 蒸汽
D. 雾
E. 以上都不是

正确答案：C。蒸汽